乳牙最易患龋的牙面是
A. 乳切牙近中面和唇面
B. 乳尖牙唇面
C. 乳尖牙远中面和近中面
D. 第一乳磨（牙合）面和远中面
E. 第二乳磨（牙合）面和远中面

正确答案：A。乳切牙近中面和唇面

解析：本题考查乳牙龋病。乳牙最易患龋的牙面是乳切牙近中面和唇面（A对）。乳牙龋病的好发牙位，以上颌乳切牙、下颌乳磨牙多见,其次是上颌乳磨牙、上颌乳尖牙，下颌乳尖牙和下颌乳切牙较少。乳牙龋病的好发牙面，在上颌：乳中切牙易患龋牙面为近中面，其次是远中面和唇面；乳侧切牙以近中面、唇面多见；乳尖牙则多见于唇面，其次是远中面；第一乳磨牙多见于（牙合）面，其次为远中面；第二乳磨牙则多发生于（牙合）面和近中面。在下颌：乳中切牙和侧切牙较少患龋，患龋多出现于近中面；乳尖牙多见于唇面，其次是远中面和近中面；第一乳磨牙多见于（牙合）面，其次为远中面；第二乳磨牙则多发生于（牙合）面和近中面。各年龄的乳牙龋病发生部位有明显的特点，1～2岁时，主要发生于上颌乳前牙的唇面和邻面；3～4岁时，多发生于乳磨（牙合）面的窝沟；4～5岁时，好发于乳磨牙的邻面。